常用的心理评估方法不包括
A. 观察法
B. 调查法
C. 实验法
D. 会谈法
E. 测验法

正确答案：C。实验法

解析：心理评估的方法有观察法（A对）、会谈法（D对）、调查法（B对）、心理测验法（E对）及临床评定量表（C错，为本题正确答案）。观察法是通过对被评估者的行为表现直接或间接的观察或观测而进行心理评估的一种方法。会谈法的基本形式是主试者与被评估者面对面的语言交流。调查法是当有些资料不可能从当事人那里获得时，就要从相关的人或材料那里得到。心理测量就是依据一定法则，用数量化手段对心理现象或行为加以确定和测定。